在混悬剂中起润湿、助悬、絮凝或反絮凝作用的附加剂
A. 助悬剂
B. 稳定剂
C. 润湿剂
D. 反絮凝剂
E. 絮凝剂

正确答案：B。稳定剂

解析：本题考查混悬剂。在混悬剂中起润湿、助悬、絮凝或反絮凝作用的附加剂为稳定剂（B对）。其种类包括助悬剂（A错）、润湿剂（C错）、反絮凝剂（D错）或絮凝剂（E错）。